关于膀胱的形态，何者错误
A. 空虚时呈三棱锥体形
B. 顶端尖细，朝向下方称膀胱尖
C. 底呈三角形，朝向后下方
D. 尖、底之间的大部分称膀胱体
E. 颈在膀胱的下部

正确答案：B。顶端尖细，朝向下方称膀胱尖

解析：朝向下方（B错，为本题正确答案）为膀胱底的特点。膀胱空虚时呈三棱锥体形（A对），顶端尖细，朝向下方；底呈三角形，朝向后下方（C对）； 尖与底之间为膀胱体（D对），最下部为膀胱颈（E对）。